对正气过于虚弱的正虚邪实病证，应采取的治则是
A. 扶正
B. 祛邪
C. 扶正与祛邪兼用
D. 先祛邪后扶正
E. 先扶正后祛邪

正确答案：E。先扶正后祛邪

解析：本题考查的是扶正祛邪的运用。对正气过于虚弱的正虚邪实病证，应采取的治则是先扶正后祛邪（E对）。扶正祛邪的运用：运用扶正祛邪治则时，要认真细致地观察和分析正邪两方消长盛衰的情况，并根据正邪在矛盾斗争中的地位，决定扶正与祛邪的主次和先后。1.扶正（A错）：扶正适用于以正气虚为主要矛盾，而邪气也不盛的虚性病证。2.祛邪（B错）：祛邪适用于以邪实为主要矛盾，而正气未衰的实性病证。3.扶正与祛邪兼用（C错）：扶正与祛邪兼用又称“攻补兼施”，适用于正虚邪实病证，两者同时兼用，则扶正不留邪，祛邪又不会伤正。4.先祛邪后扶正（D错）：先祛邪后扶正适用于虽为邪盛正虚，但正气尚能耐攻，或同时兼顾扶正反会助邪的病证。5.先扶正后祛邪：先扶正后祛邪适用正虚邪实，以正虚为主的病证。